大肠津亏证的主症是
A. 口干咽燥
B. 口臭头晕
C. 便干难以排出
D. 舌红苔白干
E. 脉象细涩

正确答案：C。便干难以排出

解析：阴液损伤，津液不足，肠失濡润，则便干难以排出（C对）。口干咽燥是由于津液亏损，不能上润所致（A错）。口臭头晕是由于大便日久不解，浊气不得下泄而上逆所致（B错）。舌红苔白干是由于阴津亏损，不能上润所致（D错）。脉象细涩是由于阴液不能充盈濡润脉道所致（E错）。